女，23岁。交通事故伤及左季肋部，自述左季肋部疼痛，后疼痛缓解，3日后突发腹痛加剧，出现失血性休克。查体：全腹压痛反跳痛及肌紧张。最可能诊断是
A. 宫外孕破裂
B. 肝破裂
C. 肠穿孔
D. 延迟性脾破裂
E. 肠梗阻

正确答案：D。延迟性脾破裂

解析：青年女性患者，左季肋区外伤史（提示脾脏损伤），3日后突发腹痛加剧，全腹压痛、反跳痛及肌紧张（腹膜刺激征），出现失血性休克（提示脾破裂出血），结合患者病史和体查，最可能的诊断为延迟性脾破裂（D对）。宫外孕破裂（A错）最常见的为输卵管异位妊娠破裂，患者应有明确的停经史，常表现为下腹部疼痛，阴道不规则流血，腹部压痛和肌紧张可不明显。肝破裂（B错）常见于右季肋区受伤的病人，可因胆汁外漏早期出现严重的腹膜炎症状，休克多于伤后早期发生。肠穿孔（C错）多表现为突发的腹部疼痛，压痛、反跳痛明显，由于出血量较少，一般不出现休克的表现。肠梗阻（E错）以呕吐、腹痛、腹胀及停止自肛门排便排气为主要表现，腹膜刺激征不明显，查体可见触及腹部包块。